月经周期中，促进卵泡发育成熟的主要激素是
A. 卵泡刺激素
B. 人绒毛膜促性腺激素
C. 黄体生成素
D. 雌激素
E. 孕激素

正确答案：A。卵泡刺激素

解析：在月经周期中，卵泡刺激素、雌激素（D错）与黄体生成素（C错）均对卵泡发育成熟有一定作用。其中，在（窦）卵泡发育期，卵泡刺激素与雌激素二者协同作用；进入排卵前卵泡期后，黄体生成素在卵泡刺激素的作用下生成，并促进雌激素的合成分泌，原二者进一步促进卵泡的成熟，在此过程中，以卵泡刺激素作用最大（A对）。人绒毛膜促性腺激素（B错）主要用于月经期黄体的维持、促进及对妊娠期的维持。孕激素（E错）以孕酮为主，通常在雌激素基础上发挥效应，在月经周期中，与雌激素共同作用，使子宫内膜发生典型分泌性变化。